脊髓灰质炎病毒的致病特点不包括
A. 粪-口途径传播
B. 5岁以下幼儿易感
C. 多为隐性感染
D. 易侵入中枢神经系统引起肢体痉挛
E. 病后获得牢固免疫

正确答案：D。易侵入中枢神经系统引起肢体痉挛